病理性蛋白尿，可见于
A. 剧烈活动后
B. 严重受寒
C. 直立性蛋白尿
D. 妊娠中毒
E. 以上均非

正确答案：D。妊娠中毒

解析：病理性蛋白尿分为：肾前性蛋白尿，如本周蛋白尿、血红蛋白尿及肌红蛋白尿；肾性蛋白尿，如肾小球和肾小管炎症、血管病变、中毒等；肾后性蛋白尿，如肾盂、输尿管、膀胱和尿道炎症、肿瘤、结石等。故妊娠中毒出现的蛋白尿为病理性蛋白尿（D对）。剧烈活动（A错）、严重受寒（B错）、直立性蛋白尿（C错）为生理性蛋白尿。